关于骨骼肌兴奋-收缩偶联，哪项错误
A. 电兴奋通过横管系统传向肌细胞深部
B. 横管膜产生动作电位
C. 终末池中Ca²⁺逆浓度差进入肌浆中
D. 纵管终末池对Ca²⁺通透性
E. Ca²⁺到达肌丝区，触发肌丝滑行

正确答案：C。终末池中Ca²⁺逆浓度差进入肌浆中